分离大黄酸葡萄糖苷和大黄素甲醚葡萄糖苷常用
A. 硅胶柱色谱法
B. KNO₃硅胶柱色谱法
C. NaNO₃硅胶柱色谱法
D. AgNO₃硅胶柱色谱法
E. 氧化铝柱色谱法

正确答案：A。硅胶柱色谱法

解析：本题考查的是色谱分离法。分离大黄酸葡萄糖苷和大黄素甲醚葡萄糖苷常用硅胶柱色谱法（A对）。色谱法是分离蒽醌苷类化合物最有效的方法。过去主要应用硅胶柱色谱，近年来葡聚糖凝胶柱色谱和反相硅胶柱色谱得到普遍应用，使极性较大的蒽醌苷类化合物得到有效分离。挥发油中萜类成分的异构体较多，有许多仅是双键数目或位置不同，故可利用不同双键和硝酸银形成络合物的难易来分离。多用硝酸银-硅胶（D错）或硝酸银-氧化铝柱色谱及薄层色谱例如细辛挥发油，通过20%硝酸银-硅胶柱，苯-乙醚（5∶1）洗脱，洗脱顺序为α-细辛醚→β-细辛醚→欧细辛醚。氧化铝柱色谱（E错），氧化铝对黄酮类化合物吸附力强，特别是具有3-羟基、4-羰基或5-羟基、4-羰基或邻二酚羟基结构的黄酮类化合物与铝离子络合而被牢固地吸附在氧化铝柱上，难以洗脱，所以很少应用。但是当黄酮类化合物分子中没有上述结构，或虽有上述结构但羟基已被甲基化或苷化时，也可用氧化铝柱分离。